来源于百合科植物块根的药材是
A. 香附
B. 玉竹
C. 浙贝母
D. 射干
E. 天冬

正确答案：E。天冬

解析：本题考查的是天冬的来源。来源于百合科植物块根的药材是天冬（E对）。天冬：【来源】为百合科植物天冬的干燥块根。香附（A错）：【来源】为莎草科植物莎草的干燥根茎。玉竹（B错）：【来源】为百合科植物玉竹的干燥根茎。浙贝母（C错）：【来源】为百合科植物浙贝母的干燥鳞茎。射干（D错）：【来源】为鸢尾科植物射干的干燥根茎。